青春期龈炎局部刺激因素以什么为主
A. 不良修复体
B. 食物嵌塞
C. 牙石
D. 菌斑
E. （牙合）创伤

正确答案：D。菌斑

解析：本题考查青春期龈炎的病因。青春期龈炎是受内分泌影响的牙龈炎，主要见于青春期这一年龄段的人群，由于乳恒牙的更替、牙齿排列不齐等，造成牙齿不易清洁，加之该年龄段患者不易保持良好的口腔卫生，所以菌斑（D对）仍是青春期龈炎的主要病因。不良修复体（A错）引起的龈炎常见于进行口腔修复治疗的高龄患者，青少年的牙齿普遍基本健康，一般口内没有修复体存在。食物嵌塞（B错）是引起急性龈乳头炎的局部刺激因素。牙石（C错）是菌斑的附着物，为菌斑的生长提供依托，不是青春期龈炎的刺激因素。（牙合）创伤（E错）是垂直性骨吸收的局部刺激因素。